男，48岁，2年前因“胃溃疡穿孔”行胃大部切除术。近5个月常于清晨空腹时出现精神症状，进食后缓解。今晨被家人发现神志不清送来急诊。查血糖2.2mmol/L，静脉注射葡萄糖溶液后逐渐清醒。低血糖最可能的原因是
A. 自主神经功能紊乱
B. 营养不良
C. 胃大部切除术后
D. 胰岛素瘤
E. 反应性低血糖

正确答案：D。胰岛素瘤

解析：患者常于清晨空腹时出现精神症状（血糖过低可引起大脑功能障碍），进食后缓解，本次发作时查血糖2.2mmol/L，静脉注射葡萄糖后症状缓解，存在典型的Whipple三联症，低血糖最可能的原因是胰岛素瘤（D对）。自主神经功能紊乱（A错）主要表现为面部潮红、出汗异常、瞳孔扩大或缩小、心动过速或过缓、流涎、寒战、腹痛等表现，与该患者表现不符，故应排除。营养不良（B错）多表现为消瘦、体重下降，一般不会出现精神症状。胃大部切除术后（C错）晚期倾倒综合征（P345）可出现头晕、面色苍白、出冷汗等低血糖表现，但多发生于餐后2～4小时。反应性低血糖（E错）主要表现为发作性的心慌、出汗、乏力，多在餐后2～4小时发生。